卫生事业的社会功能包括
A. 发展社会经济，维护社会安定
B. 发展社会经济，建设精神文明，保障基本人权和维护社会安定
C. 建设精神文明，保障基本人权
D. 维护社会安定，保障基本人权

正确答案：B。发展社会经济，建设精神文明，保障基本人权和维护社会安定

解析：本题考查卫生事业的社会功能。卫生事业的社会功能包括：发展社会经济，建设精神文明，保障基本人权，维护社会安定（B对ACD错）。